急性感染性心内膜炎
A. 立克次体
B. 金黄色葡萄球菌
C. 肺炎球菌
D. 淋球菌
E. 草绿色链球菌

正确答案：B。金黄色葡萄球菌

解析：链球菌和葡萄球菌是引起IE（感染性心内膜炎）的主要病原微生物。其中急性感染性心内膜炎（P308）主要由金黄色葡萄球菌（B对）引起，少数由肺炎球菌（C错）、淋球菌（D错）、A族链球菌和流感杆菌所致。草绿色链球菌（E错）为亚急性感染性心内膜炎的常见致病菌；立克次体（A错）为自体瓣膜心内膜炎的少见致病菌。